说明书中没有儿童用药剂量时，可以根据儿科用药换算方法进行计算。下列计算方法，错误的是
A. 小儿药物剂量=（年龄×成人剂量）/小儿体表面积（m²）
B. Fried公式，婴儿药物剂量=月龄×成人剂量/150
C. 儿童剂量=成人剂量×儿童体表面积（m²）/1.73（m²）
D. 儿童剂量=成人剂量×小儿体重（kg）/70
E. Young公式，小儿药物剂量=（年龄×成人剂量）/（年龄+12）

正确答案：A。小儿药物剂量=（年龄×成人剂量）/小儿体表面积（m²）

解析：本题考查儿童用药计算。儿童剂量的计算方法：1.根据成人剂量按小儿体重计算（1）根据成年人剂量计算：小儿剂量=成年人剂量×小儿体重/70kg（D对）；（2）根据推荐的小儿剂量计算：每次（日）剂量=小儿体重×每次（日）药量/kg。2.根据小儿年龄计算：（1）Fried公式：婴儿药物剂量=月龄×成人剂量/150（B对）（2）Young公式：小儿药物剂量=（年龄×成人剂量）/（年龄+12）（A错，为本题的正确答案）（E对）。3.根据体表面积计算：儿童剂量=成人剂量×儿童体表面积（m²）/1.73（C对）。